生产过程中不产生粉尘的工艺过程是
A. 岩石钻孔
B. 粮谷类加工
C. 煤燃烧
D. 趁热过滤
E. 铅蒸汽冷凝

正确答案：D。趁热过滤